下列神经纤维中，属节后纤维的为
A. 内脏大神经
B. 内脏小神经
C. 盆内脏神经
D. 灰交通支
E. 白交通支

正确答案：D。灰交通支

解析：内脏大神经（A错）和内脏小神经（B错）均由节前纤维构成。配内脏神经（C错）由骶副交感核发出的节前纤维组成。灰交通支（D对）由交感干神经节细胞发出的节后纤维组成。白交通支（E错）主要由有髓鞘的节前纤维组成。